病人出现猿手畸形应想到
A. 尺神经损伤
B. 桡神经损伤
C. 肌皮神经和腋神经共同损伤
D. 尺神经和桡神经共同损伤
E. 正中神经损伤

正确答案：E。正中神经损伤

解析：尺神经损伤（A错）出现掌指关节过伸，出现“爪形手”。桡神经损伤（B错），导致前臂伸肌群的瘫痪，表现为抬前臂时呈“垂腕”状。肌皮神经损伤时表现为屈肘无力以及前臂外侧部皮肤感觉的减弱，腋神经损伤导致三角肌瘫痪，病人肩部失去圆隆的外形（C错）。正中神经损伤（E对）表现为鱼际肌萎缩，手掌变平呈“猿掌”。